急性白血病引起贫血最重要的原因是
A. 出血
B. 红细胞系统增殖受白血病细胞干扰
C. 无效红细胞形成
D. 造血原料缺乏
E. 红细胞寿命缩短

正确答案：B。红细胞系统增殖受白血病细胞干扰

解析：急性白血病引起贫血最重要的原因是骨髓红系增殖受白血病细胞的干扰（B对）。急性白血病是造血干祖细胞的恶性克隆性疾病，发病时骨髓中异常的原始细胞及幼稚细胞（白血病细胞）大量增殖而抑制正常造血，红系增生受抑，引起贫血，粒系增生受抑，则可引起感染，巨核系增生受抑，则可引起出血。出血（P571）（A错）可引起贫血，但不是急性白血病贫血的主要原因；无效红细胞形成（P552）（C错）即原位溶血，常见于巨幼细胞贫血、MDS；造血原料缺乏（P537）（D错）引起的贫血常见于缺铁性贫血、巨幼细胞性贫血；红细胞寿命缩短（P551）（E错）引起的贫血常见于溶血性贫血。